肝硬化食管静脉曲张破裂大出血后，可能出现的表现不包括
A. 血尿素氮增高
B. 脾脏缩小
C. 腹水减少
D. 意识障碍
E. 少尿

正确答案：C。腹水减少

解析：肝硬化食管静脉曲张破裂大出血后，大量血液蛋白质的消化产物在肠道被吸收，血中尿素氮浓度升高（A对）；门静脉压力暂时降低，因此脾脏充血减轻而缩小（B对）；大出血导致失血性周围循环衰竭，可出现意识障碍（D对）；由于全身血容量重新分布，导致肾灌注量减少，可出现肾前性少尿（E对）；肝硬化腹水形成是长期慢性多因素的过程，因此食管静脉曲张破裂大出血后不会出现腹水减少（C错，为本题正确答案）。